含淀粉多的药材和饮片，如天麻、山药、粉葛等，应贮于
A. 阴凉、通风处
B. 密闭、阴凉处
C. 阴凉、干燥处
D. 通风、干燥处
E. 密封、凉暗处

正确答案：D。通风、干燥处

解析：本题考查的是中药饮片的贮藏要求。含淀粉多的药材和饮片，如天麻、山药、粉葛等，应贮于通风、干燥处（D对）。含淀粉多的药材和饮片，如天麻、山药、粉葛根、葛根等，应贮于通风、干燥处，以防虫蛀。加酒炮制的当归、常山、大黄等饮片，加醋炮制的芫花、大戟、香附、甘遂等饮片，均应贮于密闭容器中，置阴凉处（B错）贮存。含挥发油多的药材和饮片，如薄荷、当归、川芎、荆芥等，贮藏时室温不可太高，否则容易走失香气或泛油，应置阴凉、干燥处（C错）贮存。